关于上颌中切牙唇面解剖形态的说法正确的是
A. 近中缘与切缘略突，远中缘较直，颈缘呈弧形
B. 切1/3处可见两条横行发育沟
C. 外形高点为颈2/3处
D. 远中切角似直角，近中切角略圆钝
E. 牙冠唇面形态常可分为卵圆形、尖圆形、方圆形三种，常与人的面型相协调

正确答案：E。牙冠唇面形态常可分为卵圆形、尖圆形、方圆形三种，常与人的面型相协调

解析：本题考查上颌中切牙唇面解剖形态特点。牙冠唇面形态常可分为卵圆形、尖圆形、方圆形三种，常与人的面型相协调（E对）。牙冠唇面形态中，卵圆形为牙冠唇面颈部和切端均较窄，约占72%；尖圆形为牙冠唇面颈部显著缩小，约占26%；方圆形为牙冠唇面颈部宽度略窄于切端，约占2%。牙冠唇面形态常与人的面型相协调。上颌中切牙近中缘和切缘较直，远中缘略突（A错），唇面较平坦，近似梯形，切颈径大于近远中径。颈缘呈弧形，切1/3为两条纵形发育沟（B错），外形高点为颈1/3处（C错）。近似直角的为切缘与近中缘相交形成的近中切角，略圆钝的为与远中缘相交形成的远中切角（D错）。该牙初萌出时切缘可见三个切缘结节，随着功能性磨耗而逐渐变平直。